最能反映水体历史污染状况的调查监测方法是
A. 水质监测
B. 水生生物的监测
C. 地表水污染物监测
D. 水体底质的监测
E. 水体基本状况调查

正确答案：D。水体底质的监测

解析：本题考查水体底质的监测。底质是指江河、湖泊、水库等水体底部的淤泥，是水体的重要组成部分。底质中有害物质（特别是重金属）含量的垂直分布一般能反映水体污染历史状况。因此最能反映水体历史污染状况的调查监测方法是水体底质的监测（D对ABCE错）。